采收加工时，需缓缓烘焙至内部变黑，约八成干，再捏成团块的药材是
A. 白芍
B. 黄芩
C. 生地黄
D. 半夏
E. 天麻

正确答案：C。生地黄

解析：本题考查的是地黄的采收加工。采收加工时，需缓缓烘焙至内部变黑，约八成干，再捏成团块的药材是生地黄（C对）。生地黄：【采收加工】秋季采挖，除去芦头、须根及泥沙，洗净，鲜用者习称“鲜地黄”。将鲜生地缓缓烘焙，至内部变黑，约八成干，捏成团块，习称“生地黄”。白芍（A错）：【采收加工】夏、秋二季采挖，洗净，除去头尾及细根，置沸水中煮后除去外皮或去皮后再煮，晒干。黄芩（B错）：【采收加工】春、秋二季采挖，除去须根及泥沙，晒至半干，撞去粗皮，晒干。半夏（D错）：【采收加工】夏、秋二季均可采挖，洗净泥土，除去外皮及须根，晒干。天麻（E错）：【采收加工】立冬后至次年清明前采挖，除去地上苗茎，立即洗净，蒸至透心，敞开低温干燥。